口腔鳞癌构成比中居第二或第三位的是
A. 舌癌
B. 腭癌
C. 口底癌
D. 唇癌
E. 牙龈癌

正确答案：E。牙龈癌

解析：牙龈癌在口腔鳞癌构成比张居第二位或第三位。掌握“颊癌、口底癌及唇癌”知识点。